属于膜迷路的结构是
A. 蜗螺旋管
B. 骨半规管
C. 耳蜗
D. 球囊
E. 副交感神经兴奋瞳孔开大肌,使瞳孔开大

正确答案：D。球囊

解析：骨半规管（B错）和耳蜗（C错），以及前庭组成骨迷路。耳蜗由蜗轴和蜗螺旋管（A错）构成。膜迷路是由椭圆囊和球囊（D对）、膜半规管和蜗管3 部分组成。E选项与题干无关。